与相对标准偏差计算有关的量包括
A. 测定结果为Xi
B. 测定结果的平均值
C. 测定次数n
D. 相关系数r
E. 回归方程的斜率b

正确答案：A、B、C。测定结果为Xi；测定结果的平均值；测定次数n